关于急性心肌梗死心肌损伤标记物的描述不正确的是
A. 肌红蛋白起病后2小时内升高，12小时内达到高峰，24～48小时恢复正常
B. 肌钙蛋白起病后6小时内升高，5～6天恢复正常
C. CK-MB起病后4小时内增高，16～24小时达高峰，3～4天恢复正常
D. AST在起病后6～10小时开始升高，3～6天恢复正常
E. LDH在起病后8～10小时后升高，1～2周内恢复正常

正确答案：B。肌钙蛋白起病后6小时内升高，5～6天恢复正常

解析：肌钙蛋白起病3～4小时后升高，其中cTnI于11～24达高峰，7～10天降至正常，cTnT于24～48小时达高峰，10～14天降至正常（B错，为本题正确答案）。肌红蛋白起病后2小时内升高，12小时内达到高峰，24～48小时恢复正常（A对）。CK-MB起病后4小时内增高，16～24小时达高峰，3～4天恢复正常（C对）。AST在起病后6～10小时开始升高，3～6天恢复正常（D对）。LDH在起病后8～10小时后升高，1～2周内恢复正常（E对）。